下列哪项出现时提示病变已由牙龈炎转变为牙周炎
A. 牙龈变为深红色或暗红色
B. 龈缘变厚，不再紧贴牙面
C. 牙龈松软脆弱，缺乏弹性
D. 龈沟底在釉牙骨质界的根方，深度超过3mm
E. 牙龈探诊出血

正确答案：D。龈沟底在釉牙骨质界的根方，深度超过3mm

解析：本题考查牙龈炎和牙周炎的区别。龈沟底在釉牙骨质界的根方，深度超过3mm（D对）出现时提示病变已由牙龈炎转变为牙周炎。牙龈变为深红色或暗红色（A错）、龈缘变厚，不再紧贴牙面（B错）、牙龈松软脆弱，缺乏弹性（C错）、牙龈探诊出血（E错）均既可以为牙龈炎也可以为牙周炎，不能确定为牙周炎。牙龈炎和牙周炎的主要区别在于牙龈炎不侵犯支持组织（没有附着丧失和牙槽骨吸收），牙周炎有附着丧失、牙周袋形成、牙槽骨吸收。牙龈炎治疗后病变可逆，组织恢复正常，而牙周炎治疗后炎症消退，病变静止，但已破坏的支持组织难以恢复正常。